内服活血化瘀止痛，外用止血生肌敛疮的药是
A. 干漆
B. 血竭
C. 苏木
D. 虎杖
E. 自然铜

正确答案：B。血竭

解析：本题考查血竭的功效。内服活血化瘀止痛，外用止血生肌敛疮的药是血竭（B对）。血竭【功效】活血定痛，化瘀止血，生肌敛疮。干漆（A错）【功效】破血祛瘀，杀虫。苏木（C错）【功效】活血祛瘀，消肿止痛。虎杖（D错）【功效】利湿退黄，清热解毒，活血祛瘀，化痰止咳，泻下通便。自然铜（E错）【功效】散瘀止痛，接骨疗伤。